畸形中央尖高度约为
A. 1～3mm
B. 3～4mm
C. 2～4mm
D. 4mm
E. 4mm以上

正确答案：A。1～3mm

解析：畸形中央尖一般均位于（牙合）面中央窝处，呈圆锥形突起。此外，该尖也可出现于颊嵴、舌嵴、近中窝和远中窝。中央尖高度1～3mm，形态可为圆锥形、圆柱形或半球形等。掌握“畸形中央尖”知识点。